关于执业药师资格考试和注册管理的说法，正确的是
A. 香港、澳门、台湾居民，按照规定的程序和报名条件，可以报名参加国家执业药师资格考试
B. 不在中国就业的外国人，符合规定的学历条件，可以报名参加国家执业药师资格考试
C. 执业药师执业单位包括医药院校，科研单位，药品检验机构
D. 在香港，澳门注册的药剂师可以直接递交注册申请资料办理执业药师注册

正确答案：A。香港、澳门、台湾居民，按照规定的程序和报名条件，可以报名参加国家执业药师资格考试

解析：本题考查的是执业药师职业资格考试的报名条件。关于执业药师资格考试和注册管理的说法，正确的是香港、澳门、台湾居民，按照规定的程序和报名条件，可以报名参加国家执业药师资格考试（A对）。执业药师职业资格考试的报名条件：凡中华人民共和国公民和获准在我国境内就业的外籍人员（B错），具备以下条件之一者，均可申请参加执业药师职业资格考试：①取得药学类、中药学类专业大专学历，在药学或中药学岗位工作满5年；②取得药学类、中药学类专业大学本科学历或学士学位，在药学或中药学岗位工作满3年；③取得药学类、中药学类专业第二学士学位、研究生班毕业或硕士学位，在药学或中药学岗位工作满1年；④取得药学类、中药学类专业博士学位；⑤取得药学类、中药学类相关专业相应学历或学位的人员，在药学或中药学岗位工作的年限相应增加1年。凡符合执业药师职业资格考试相应规定的香港、澳门、台湾居民，按照规定的程序和报名条件，可报名参加考试（D错）。执业药师应当按照执业类别、执业单位、执业范围进行注册和执业。执业类别为药学类、中药学类、药学与中药学类；执业范围为药品生产、药品经营、药品使用以及其他需要提供药学服务的单位。机关、院校、科研单位、药品检验机构不属于规定的注册执业单位（C错）。